糖尿病病人出现糖尿的原因是
A. 血糖浓度增加
B. 髓质中渗透压增高
C. 滤过率下降
D. 部分近球小管对糖吸收达到极限
E. 滤过膜面积增加

正确答案：D。部分近球小管对糖吸收达到极限

解析：糖尿病病人血糖升高，若超出了近曲小管对糖的重吸收能力（D对），则尿中可出现葡萄糖，尿糖呈现阳性反应。血糖浓度增加（A错）不一定超出近曲小管的重吸收能力，不一定出现尿糖阳性。髓质中渗透压增高（B错）为尿液浓缩的形成机制，与糖尿病人尿糖阳性无关。滤过率下降（C错）时，肾糖阈升高，尿糖阴性。肾脏病变时，肾小球滤过膜面积（E错）不会出现增加的情况。